下列有关女童体重叙述正确的是
A. 1周岁时为出生体重的2倍
B. 2周岁时为出生体重的3倍
C. 4～5个月时为出生时的1.5倍
D. 1周岁时为出生时的3倍
E. 2周岁时为1周岁时的2倍

正确答案：D。1周岁时为出生时的3倍

解析：本题考查女童期的体格生长发育特点。1周岁时为出生体重的3倍（D对A错）；4～5个月时为出生时的2倍（C错）；2周岁时增至出生体重的4倍（BE错）。